Vincent纪念医院妇产科医师Herbst注意到：于1966～1969年间该院诊断了7例年轻女性阴道腺癌病例，这是一种罕见的女性生殖系统癌症，且多发生于50岁以上的妇女中。为详细了解这些病例从胚胎期至发病前的情况，以及她们的母亲在妊娠期的情况，Herbst将1969年Boston另一所医院发生的一个阴道透明细胞癌的20岁女子也包括在内。这样8个病例，每个病例配4个非该病患者做对照，要求与病例在同等级病房中出生时间前后不超过5天的女婴作为对照候选人，优先选择与病例出生时间最近者为对照。对病例、对照以及她们的母亲进行随访调查。通过对8个病例与32个对照的研究，Herbst等作出结论，母亲在妊娠早期服用己烯雌酚使她们在子宫中的女儿以后发生阴道腺癌的危险性增加。该研究属于
A. 现况研究
B. 实验研究
C. 病例对照研究
D. 队列研究
E. 生态学研究

正确答案：C。病例对照研究